有关局限型和广泛型侵袭性牙周炎共同的临床表现描述错误的是
A. 菌斑堆积量与牙周组织破坏程度相符
B. 伴放线聚集杆菌比例升高
C. 吞噬细胞异常
D. 巨噬细胞过度反应
E. 附着丧失和牙槽骨吸收有自限性

正确答案：A。菌斑堆积量与牙周组织破坏程度相符

解析：侵袭性牙周炎按其患牙的分布可分为局限型和广泛型。具有一些共同的临床表现：①菌斑堆积量与牙周组织破坏的严重程度不相符；②伴放线聚集杆菌比例升高，在一些人群中牙龈卟啉单胞菌比例可能升高；③吞噬细胞异常；④巨噬细胞过度反应，包括PGE2和IL-1β水平升高；⑤附着丧失和牙槽骨吸收有自限性。掌握“侵袭性牙周炎”知识点。